花粉粒类球形，表面有条形雕纹的药材是
A. 金银花
B. 洋金花
C. 丁香
D. 红花
E. 菊花

正确答案：B。洋金花

解析：本题考查的是洋金花的显微鉴别。花粉粒类球形，表面有条形雕纹的药材是洋金花（B对）。洋金花【显微鉴别】粉末：淡黄色。①花粉粒呈类球形或长圆形，直径42～65㎛，外壁有细点状条形雕纹，自两极向四周呈放射状排列。②腺毛有两种，另一种头部为2～5个细胞，柄1～2个细胞；另一种头部为单细胞，柄2～5个细胞。③不同部位的非腺毛也不完全相同，花萼上由1～3个细胞组成，具壁疣；花冠上长至10个细胞，微具壁疣；花丝基部的粗大，由1～5个较短的细胞组成。④花萼、花冠薄壁组织中有草酸钙簇晶、砂晶及方晶。金银花（A错）【显微鉴别】粉末：浅黄色。①腺毛有两种，一种头部呈倒圆锥形，顶端平坦，有的细胞含淡黄色物，另一种头部类圆形或略扁圆形，腺柄2～4个细胞，长24～80㎛。②非腺毛为单细胞，有二种，一种长而弯曲，壁薄，有微细疣状突起；另一种非腺毛较短，壁稍厚，具壁疣，有的具单或双螺纹。③花粉粒众多，黄色，球形，外壁具细刺状突起，萌发孔3个。④柱头顶端表皮细胞呈绒毛状。⑤薄壁细胞中含细小草酸钙簇晶。丁香（C错）【显微鉴别】粉末：暗红棕色。①油室多破碎，分泌细胞界限不清，含黄色油状物。②纤维梭形，顶端钝圆，壁较厚。③花粉粒众多，极面观三角形，赤道面观双凸镜形，具3副合沟。④草酸钙簇晶众多，存在于较小的薄壁细胞中。⑤表皮细胞呈多角形，有不定式气孔，副卫细胞6～7个。红花（D错）【显微鉴别】粉末：橙黄色。①柱头表皮细胞分化成圆锥形末端较尖的单细胞毛。②花各部均有呈长管道状分泌细胞，分泌细胞单列纵向连接，细胞内充满淡黄色至红棕色物。③花瓣顶端表皮细胞分化成乳头状绒毛。④花粉粒圆球形、椭圆形或橄榄形，外壁有短刺及疣状雕纹，萌发孔3个。菊花（E错）【显微鉴别】粉末：淡黄色。①花粉粒黄色类球形，外壁较厚，具粗齿，有3个萌发孔。②T形毛大多断碎，顶端细胞长大。③无柄腺毛鞋底形，4～6个细胞，两两相对排列，外被角质层。④花冠表皮细胞垂周壁波状弯曲，平周壁有细密的放射状条纹。⑤苞片表皮细胞狭长，垂周壁波状弯曲，平周壁有粗条纹；气孔长圆形，副卫细胞3～6个。⑥花粉囊内壁细胞壁呈网状或条状增厚。